再造散的组成药物中含有
A. 川芎
B. 当归
C. 丹参
D. 桃仁
E. 红花

正确答案：A。川芎

解析：该题考查再造散的组成，属记忆内容。再造散功用助阳益气，解表散寒，由黄芪、人参、桂枝、甘草、熟附子、细辛、羌活、防风、川芎、煨生姜、大枣、赤芍组成（A对）。记忆：再造桂枝汤，欺负穷人抢新房。芪附芎人羌辛防。